患者，男，46岁，拟行肠道手术，木前1天使用导泻药的方法是
A. 50%葡萄糖注射液湿敷
B. 50%硫酸镁溶液口服
C. 25%硫酸镁注射液稀释后静脉注射
D. 5%氯化钙注射液静脉滴注
E. 50%硫酸镁溶液湿敷

正确答案：B。50%硫酸镁溶液口服

解析：本题考查硫酸镁剂型与给药途径的选择。50%硫酸镁溶液口服（B对）用于导泻。药物剂型的选择与临床疗效和给药途径密切相关，不同的给药途径药物作用也不同。例如硫酸镁静脉注射可用于治疗子痫，而口服则用于导泻，湿敷则消肿。